引起生物地球化学性疾病的主要原因是环境受到
A. 工业废弃物的污染
B. 汽车尾气的污染
C. 生物病原体的污染
D. 化学污染物和生物病原体的联合作用
E. 地质结构组成异常的影响

正确答案：E。地质结构组成异常的影响

解析：本题考查引起生物地球化学性疾病的主要原因。由于地壳表面化学元素分布的不均匀性，使某些地区的水和（或）土壤中某些元素过多或过少，当地居民通过饮水、食物等途径摄入这些元素过多或过少，而引起某些特异性疾病，称为生物地球化学性疾病。引起该疾病的主要原因是环境受到地质结构组成异常的影响（E对ABCD错）。